使用后可产生抗体，1年内不宜再次使用的药物是
A. 尿激酶
B. 链激酶
C. 瑞替普酶
D. 阿替普酶
E. 血凝酶

正确答案：B。链激酶

解析：本题考查链激酶。由于链激酶（B对）输注后可产生抗体，在5天～1年内重复给药，其疗效可能降低，故一年内不宜重复给药。